男，51岁。胸骨后剧烈疼痛伴大汗淋漓4小时。血压80/40mmHg，心率134次/分，面色苍白，四肢发冷。心电图提示广泛心肌梗死。该患者最理想有效治疗措施是
A. 毛花苷C强心
B. 多巴胺升压
C. 尿激酶溶栓
D. 主动脉内球囊反搏术
E. 直接PTCA术

正确答案：E。直接PTCA术

解析：患者中年男性，起病急，病程4小时，伴休克，心电图提示广泛心肌梗死，考虑诊断为急性广泛心肌梗死。患者起病为4小时，且急性心肌梗死诊断明确，最佳的治疗措施是再灌注心肌治疗。PTCA（经皮球囊冠状动脉成形术）是PCI（经皮冠状动脉介入治疗）中常用的一种技术（P226），其可以快速、安全的恢复心肌的再灌注，挽救濒临坏死的心肌，减轻梗死后心肌重塑，预后改善。目前已被公认为首选治疗急性心肌梗死的治疗方法（E对）。毛花苷C强心（P175）（A错）最适合于有快速心室率的心房颤动并心室扩大伴左心室收缩功能不全者，主要用于急性左心衰竭的治疗。多巴胺升压（P244）（B错）仅用于抗休克的治疗，对梗死心肌的再灌注效果不大。临床研究表明，在发病3小时内行溶栓治疗，梗死相关血管的开通率增高，病死率明显降低，其临床疗效与直接PCI相当。发病3～12小时内行溶栓治疗，其疗效不如直接PCI。且近年来急性ST段抬高型心肌梗死急性期行直接PCI已成为首选方法（实用内科学第14版P1490）。故对本例患者来说最理想有效治疗措施首选直接PTCA术而不是尿激酶溶栓（C错）。主动脉内球囊反搏术（D错）是辅助循环装置的一种，可为急性ST段抬高型心肌梗死合并心源性休克患者接受再灌注治疗（包括PTCA）提供最要的时间过渡和机会（实用内科学第14版P1493）。但对心肌的再灌注作用不及PTCA明显，故并非最理想有效治疗措施。